应用酶联免疫法检测抗破伤风类毒素抗体，加底物显色后，所测定的颜色的光密度值
A. 同病人血清中特异性抗体的浓度成正比
B. 同固相上结合的抗原成正比
C. 同病人血清中特异性抗体的浓度成反比
D. 同酶标记的抗体浓度成正比
E. 同酶底物的浓度成正比

正确答案：A。同病人血清中特异性抗体的浓度成正比